从金鸡纳树皮中提取得到的奎宁属于
A. 喹啉醇类药物
B. 氨基喹啉类药物
C. 磺胺类药物
D. 二氨基嘧啶类药物
E. 青蒿素类药物

正确答案：A。喹啉醇类药物